社会因素影响人类健康的机制，主要是通过这个中心环节发生作用：社会因素被人的感觉系统纳入，经过中枢神经系统的调节和控制，形成心理折射，产生心理反应及行为、社会适应和躯体功能的变化。这个中心环节是
A. 生理感受
B. 社会感受
C. 心理感受
D. 知觉感受
E. 中介感受

正确答案：C。心理感受